乳突位于
A. 蝶骨
B. 颞骨
C. 枕骨
D. 顶骨
E. 无

正确答案：B。颞骨

解析：颞骨以外耳门为中心分三部：鳞部、鼓部和岩部，岩部后份肥厚的突起，位于外耳门后方，称乳突（B对）。